片剂的薄膜包衣材料通常由高分子成膜材料组成，并可添加增塑剂、致孔剂（释放调节剂）、着色剂与遮光剂等。常用的增塑剂是
A. 丙二醇
B. 醋酸纤维素酞酸酯
C. 醋酸纤维素
D. 蔗糖
E. 乙基纤维素

正确答案：A。丙二醇

解析：本题考查片剂的包衣。丙二醇（A对）是薄膜包衣材料中常用的水溶性增塑剂；醋酸纤维素酞酸酯（B错）是肠溶性包衣材料；醋酸纤维素（C错）和乙基纤维素（E错）是水不溶性薄膜包衣材料；蔗糖（D错）为致孔剂。